河豚毒素中毒的主要临床表现
A. 呼吸数频，面色苍白
B. 共济失调，全身麻痹瘫痪
C. 视力模糊，眼睑下垂，复视
D. 呕吐，腹痛，腹泻，黄绿色水样便
E. 酒醉步，自主神经功能紊乱

正确答案：B。共济失调，全身麻痹瘫痪

解析：河豚主要含河豚毒素，是一种神经毒素，进入人体后作用于周围神经及脑干中枢致神经呈麻痹状态。早期症状是口唇、舌、指尖发麻，眼睑下垂，不久即出现消化道症状，进而出现口唇、舌尖及肢端麻木、四肢无力或肌肉麻痹、共济失调等神经系统症状。重症者出现瘫痪、言语不清、发绀、呼吸困难、神志不清、休克，最后因呼吸、循环衰竭而死亡。掌握“食品安全”知识点。